治疗失荣早期气郁痰结证，应首选的方剂是
A. 和营散坚丸
B. 柴胡清肝汤
C. 桃红四物汤
D. 化痰开郁方
E. 二陈汤

正确答案：D。化痰开郁方

解析：失荣是发于颈部及耳之前后的岩肿，相当于西医的颈部淋巴结转移癌和原发性恶性肿瘤。早期多为气郁痰结于颈部及耳之前后，故当治以理气，化痰，散结，首选化痰、理气的化痰开郁方（D对）。